属于二糖的是
A. 红景天苷
B. 苦杏仁苷
C. 果糖
D. 蔗糖
E. 洋地黄毒苷

正确答案：D。蔗糖

解析：本题考查中药的化学结构。属于二糖的是蔗糖（D对）。由2～9个单糖通过苷键结合而成的直链或支链聚糖称为低聚糖。按含有单糖的个数又可将其分为二糖、三糖、四糖等。具有游离醛基或酮基的糖称为还原糖，如二糖中的槐糖、樱草糖是还原糖。如果两个单糖都以半缩醛或半缩酮上的羟基通过脱水缩合而成的聚糖就没有还原性，如海藻糖、蔗糖等均为非还原糖。醇苷是通过醇羟基与糖端基羟基脱水而成的苷，如具有致适应原作用的红景天苷（A错）。氰苷：主要是指一类具有α-羟腈的苷，分布十分广泛。其特点是多数为水溶性，不易结晶，容易水解，尤其有酸和酶催化时水解更快。生成的苷元α-羟腈很不稳定，立即分解为醛（酮）和氢氰酸。而在碱性条件下苷元容易发生异构化。如苦杏仁苷（B错）为芳香族α-羟腈苷，存在于苦杏仁的种子中。果糖（C错）是一种单糖，是葡萄糖的同分异构体。α-去氧糖：强心苷中普遍具有α-去氧糖，如D-洋地黄毒（E错）糖等2，6-二去氧糖。氧苷（O-苷）：以苷元不同又可分为醇苷、酚苷、氰苷、酯苷和吲哚苷。